示
A. 右上颌第1前磨牙
B. 右上颌第1乳磨牙
C. 左上颌第1乳磨牙
D. 左上颌第1前磨牙
E. 左上颌第2乳磨牙

正确答案：C。左上颌第1乳磨牙

解析：⌊表示左上颌，Ⅳ表示第1乳磨牙，所以⌊Ⅳ表示左上颌第1乳磨牙(C对)。